完全性阻塞性黄疸时，正确的是
A. 尿胆原（-）尿胆红素（-）
B. 尿胆原（+）尿胆红素（-）
C. 尿胆原（-）尿胆红素（+）
D. 尿胆原（+）尿胆红素（+）
E. 粪胆素（+）

正确答案：C。尿胆原（-）尿胆红素（+）

解析：尿胆原是由肝细胞产生的结合胆红素在肠道中的细菌作用下转变而来；尿胆红素由血液中升高的结合胆红素被肾小球滤过膜滤过而产生。完全性阻塞性黄疸时，胆汁排泄受阻，结合胆红素不能进入肠道，故尿胆原阴性；排泄受阻的胆汁反流入血，血中结合胆红素升高，其为水溶性，可以通过肾小球基底膜滤出，使尿胆红素阳性（C对）。